牙本质的微量元素有
A. 镁
B. 锌
C. 碳酸钙
D. 金属磷酸盐
E. 以上均正确

正确答案：E。以上均正确

解析：牙本质的无机物主要也为磷灰石晶体，但其晶体比牙釉质中的小，与骨和牙骨质中的相似。微量元素有碳酸钙、氟化物、镁、锌、金属磷酸盐和硫酸盐。掌握“牙本质”知识点。